不属脾虚泻粪便特点的是
A. 大便稀溏
B. 大便色淡
C. 臭味不甚
D. 食后作泻
E. 大便中多粘液

正确答案：E。大便中多粘液

解析：泄泻脾胃虚弱的特点为病程较长，大便稀溏（A对），色淡（B对）无臭味（C对），食后易泻（D对）等，而大便中多粘液为痢疾的症状之一，因感受寒湿或湿热蕴结所致，故E错，为本题正确答案。